男，3岁。因发热1周伴手足硬性水肿住院。查体：球结膜充血，皮疹，颈部淋巴结肿大。给予阿司匹林后体温正常，后续阿司匹林治疗方案是
A. 热退后7天开始逐渐减量，维持4周
B. 热退后15天停药
C. 热退后7天停药
D. 热退后3天停药
E. 热退后3天开始逐渐减量，维持6～8周

正确答案：E。热退后3天开始逐渐减量，维持6～8周

解析：患儿，发热一周，并且有手足硬性水肿、球结膜充血、皮疹、淋巴结肿的临床表现，应诊断为川崎病。川崎病的治疗首选阿司匹林+丙种球蛋白，服用阿司匹林的治疗方案是热退后3天开始逐渐减量，维持6～8周（E对）。